肝糖原合成中葡萄糖载体是
A. CDP
B. ATP
C. UDP
D. TDP
E. GDP

正确答案：C。UDP